执业医师的权利是
A. 依法参与所在机构的民主管理
B. 宣传卫生保健知识
C. 保护患者隐私
D. 努力钻研业务
E. 遵守技术操作规范

正确答案：A。依法参与所在机构的民主管理

解析：《执业医师法》规定，医师在执业活动中享有对所在机构的医疗、预防、保健工作和卫生行政部门的工作提出意见和建议，依法参与所在机构的民主管理（A对）的权利。《执业医师法》规定，医师在执业活动中应当履行下列义务（P248）：①遵守法律、法规，遵守技术操作规范（E错）；②树立敬业精神，遵守职业道德，履行医师职责，尽职尽责为患者服务；③关心、爱护、尊重患者，保护患者隐私（C错）；④努力钻研业务（D错），更新知识，提高专业技术水平；⑤宣传卫生保健知识（B错），对患者进行健康教育。